王某1998年于医科大学毕业分配到市级医院工作，《中华人民共和国执业医师法》颁布三个月后，其依照有关开办医疗机构的规定申请个体开业。依据《执业医师法》卫生行政部门应
A. 批准其个体行医资格申请
B. 要求其应具备主治医师资格
C. 要求其参加国家执业医师资格考试
D. 要求其参加国家执业助理医师资格考试
E. 要求其能保证个体行医质量，才能予以受理申请

正确答案：C。要求其参加国家执业医师资格考试